提取叶中强心苷的最佳方法是
A. 甲醇提取
B. 70%乙醇提取
C. 先用石油醚，再用甲醇提取
D. 80%乙醇提取
E. 酸水提取

正确答案：B。70%乙醇提取